不能控制哮喘发作症状的药物是
A. 色甘酸钠
B. 地塞米松
C. 氨茶碱
D. 异丙肾上腺素
E. 硝苯地平

正确答案：A。色甘酸钠

解析：抗组胺药物对荨麻疹、花粉症等疗效较好，可作为首选药物，现多用第二代药物。对支气管哮喘效果差，对过敏性休克无效（A对）。糖皮质激素用于哮喘的治疗已有50年历史，是抗炎平喘药中抗炎作用最强，并有抗过敏作用的药物。地塞米松主要用于过敏性与自身免疫性炎症性疾病。多用于结缔组织病、活动性风湿病、类风湿性关节炎、红斑狼疮、严重支气管哮喘（B错）等。氨茶碱可用于β₂受体激动药不能控制的急性哮喘发作，在急性重度哮喘或哮喘持续状态时可采用氨茶碱静脉注射或静脉滴注，以迅速缓解喘息与呼吸困难等症状（C错）。异丙肾上腺素用于控制支气管哮喘急性发作，舌下或喷雾给药，起效快，作用强（D错）。高血压合并支气管哮喘可以用硝苯地平（E错）。